某单位在职工体检中发现员工高血压和超重的检出率较高。医务人员为该单位制定的健康教育与健康促进干预活动主要包括调整食堂的膳食结构、制定工间操制度和组织文体活动等。这些干预活动主要是
A. 社会因素
B. 强化因素
C. 人群因素
D. 倾向因素
E. 促成因素

正确答案：E。促成因素

解析：调整食堂的膳食结构、制定工间操制度和组织文体活动这些都是为了使职员能达到健康目的所必需的外部资源，它们的存在才有可能改变职员不良生活方式，进而降低高血压和超重的检出率（E对）。强化因素发生在实施行为后，来自行为者周围的人和行为者自身（B错）。倾向因素虽然也是先于行为，但它是指行为者自身的动机或愿望（D错）。社会因素和人群因素不是影响人行为改变的主要影响因素（AC错）。